在非处方药中西咪替丁的适应证是
A. 胃酸过多、烧心
B. 关节痛、神经痛
C. 手足癣、体癣、股癣、头癣
D. 蛔虫病、蛲虫病
E. 无痰干咳、频繁剧烈的咳嗽

正确答案：A。胃酸过多、烧心

解析：本题考查西咪替丁的适应证。在非处方药中西咪替丁的适应证是胃酸过多、烧心（A对）。西咪替丁是治疗消化性溃疡的H₂受体阻断剂，有显著抑制胃酸分泌的作用，也能抑制由组胺、分肽胃泌素、胰岛素和食物等刺激引起的胃酸分泌，并使其酸度降低，对因化学刺激引起的腐蚀性胃炎有预防和保护作用。